患者对自然环境变化，如声、光及温度过于敏感，表现了患者心理异常是
A. 人格异常
B. 情绪异常
C. 记忆异常
D. 感知觉异常
E. 思维异常

正确答案：D。感知觉异常

解析：患者对自然环境变化，如声、光及温度过于敏感，表现了患者心理异常是感知觉异常（D对）。人格异常（A错）：个性的改变，可表现为依赖性增强，被动和顺从，自卑等。情绪异常（B错）：情绪不稳定，控制能力下降，易激惹。记忆异常（C错）：记忆力异常，一些躯体疾病伴发明显的记忆减退。思维异常（E对）：判断能力下降，猜疑心理明显。